在矽肺的发生发展中
A. 进入肺内粒子大小起绝对重要作用
B. 进入肺内粉尘量起绝对重要作用
C. 上述二项意义都不大
D. 上述二项意义一样
E. 粒子大小虽有一定意义，但进入肺内粉尘的量则起重要的作用

正确答案：E。粒子大小虽有一定意义，但进入肺内粉尘的量则起重要的作用

解析：本题考查影响矽肺发病的主要因素。矽肺的发病受多种因素的影响，粉尘中游离SiO₂含量、SiO₂ 类型、粉尘浓度、分散度、接尘工龄、防护措施、接触者个体因素等都是矽肺发病的重要影响因素，在诸多影响因素中，蓄积在肺中的粉尘量越多，影响越大（E对ABCD错）。